正确描述胃的是
A. 中等充盈时位于右季肋区
B. 分为胃底、胃体和胃窦
C. 角切迹将胃窦分为幽门窦和幽门管
D. 幽门窦与幽门管之间有幽门括约肌
E. 胃的入口称贲门,出口称幽门

正确答案：E。胃的入口称贲门,出口称幽门

解析：胃在中度充盈时大部分位于左季肋区，小部分位于腹上区(A错)，胃分为贲门部、胃底、胃体和胃窦(B错)，中间沟将胃窦分为幽门窦和幽门管(C错)，幽门括约肌位于幽门瓣深面(D错)，胃的入口称贲门，出口称幽门(E对)。